诊断低位肠梗阻最可靠的证据是
A. 腹部平片示小肠多个阶梯状气液平
B. 脐周可闻气过水音
C. 阵发性腹痛伴腹胀
D. 置胃管行胃肠减压后梗阻症状明显减轻
E. 频繁呕吐、呕吐量大

正确答案：A。腹部平片示小肠多个阶梯状气液平

解析：X线检查对小肠梗阻具有重要价值。腹部平片可显示气胀肠袢和液平面，由于梗阻的部位不同，腹部平片表现也各有其特点：低位肠梗阻典型表现为多个阶梯状气液平面，高位肠梗阻表现为肠腔内鱼骨刺样改变。因此，诊断低位肠梗阻最可靠的证据是腹部平片示小肠多个阶梯状气液平（A对）。脐周可闻气过水音提示肠梗阻（B错），阵发性腹痛伴腹胀提示病情加重（C错）但均不能鉴别低位肠梗阻和高位肠梗阻。置胃管行胃肠减压后梗阻症状明显减轻，说明肠梗阻治疗有效（D错）。频繁呕吐、呕吐量大，提示高位肠梗阻（E错）。